老年人革兰氏阴性菌感染宜选
A. 头孢菌素类抗生素
B. 氨基苷类抗生素
C. 两性霉素B
D. 多黏菌素
E. 万古霉素

正确答案：A。头孢菌素类抗生素

解析：本题考查头孢菌素。头孢菌素类（A对）属于超广谱抗生素，对大多数耐药革兰阳性、阴性厌氧菌具有较强的抗菌活性，无肾毒性，比较适合老年人革兰氏阴性菌感染。氨基苷类抗生素（B错）对需氧的革兰阴性杆菌作用强，对革兰阴性球菌的作用差。两性霉素（C错）临床上用于治疗严重的深部真菌引起的内脏或全身感染。多黏菌素（D错）对多数革兰阴性杆菌有较强杀灭作用。万古霉素（E错）对金黄色葡萄球菌、化脓链球菌、肺炎链球菌等作用强。